作为幽门螺旋杆菌根除治疗后复查的首选方法是
A. 胃组织学检查
B. 快速尿素酶试验
C. 幽门螺旋杆菌培养
D. ¹⁴C尿素呼气试验
E. 血清学检查

正确答案：D。¹⁴C尿素呼气试验

解析：幽门螺杆菌的检测方法有非侵入性方法如¹⁴C尿素呼气试验（D对）、血清学检查（E错）和侵入性方法如胃组织学检查（A错）、幽门螺旋杆菌培养（C错）、快速尿素酶试验（B错）。血清学检查（E错）在幽门螺杆菌根除后仍可为阳性，故¹⁴C尿素呼气试验（D对）为幽门螺旋杆菌根除治疗后复查的首选方法。